四氟乙烷可用作气雾剂的
A. 抗氧剂
B. 乳化剂
C. 溶剂
D. 助悬剂
E. 助溶剂

正确答案：C。溶剂

解析：本题考查的是气雾剂的附加剂。四氟乙烷为气雾剂的溶剂（C对）。气雾剂可根据药物的性质添加适宜的溶剂、助溶剂（E错）、抗氧剂、抑菌剂、表面活性剂等附加剂，所加附加剂应对呼吸道、皮肤或黏膜无刺激性。气雾剂的附加剂包括：a.溶剂，某些脂溶性药物可以溶解于气雾剂的抛射剂中，如氢氟烷烃，常可以作为溶液型气雾剂的溶剂；水、甘油或脂肪酸、植物油也可以分别在O/W或W/O乳浊液型气雾剂中作为水溶性药物或脂溶性药物的溶剂。b.潜溶剂，如乙醇、丙二醇等。c.抗氧剂（A错），如维生素C、亚硫酸钠等。d.防腐剂，如羟苯乙酯等。e.表面活性剂，可作为乳化剂（B错），如硬脂酸三乙醇胺皂、聚山梨酯类等；或助悬剂（D错），如脂肪酸山梨坦类、月桂醇等。